桑葚牙是侵犯了哪颗牙齿
A. 切牙
B. 尖牙
C. 第一前磨牙
D. 第一磨牙
E. 第二磨牙

正确答案：D。第一磨牙

解析：先天性梅毒牙是由于梅毒螺旋体感染牙胚，侵犯成釉器使釉质发育障碍，在恒切牙、第一恒磨牙釉质产生特征性的发育不全改变。第一恒磨牙的病变称桑葚牙（mulberrymolars），病变牙呈圆顶形，牙尖缩窄，咬合面直径小于牙颈部直径，咬合面及牙冠近咬合面1/3表面有许多颗粒状细小的釉质球团，呈桑葚状。同时可伴有牙本质发育障碍。掌握“氟牙症、先天性梅毒牙与牙本质形成缺陷”知识点。